某男，50岁。症见眩晕、头痛、如蒙如裹、胸脘满闷。治当健脾祛湿、化痰息风，宜选用的中成药是
A. 礞石滚痰丸
B. 半夏天麻丸
C. 二陈丸
D. 橘贝半夏颗粒
E. 复方鲜竹沥液

正确答案：B。半夏天麻丸

解析：本题考查半夏天麻丸的主治。治当健脾祛湿、化痰息风，宜选用的中成药是半夏天麻丸（B对）。半夏天麻丸【主治】脾虚湿盛、痰浊内阻所致的眩晕、头痛、如蒙如裹、胸脘满闷。礞石滚痰丸（A错）【主治】痰火扰心所致的癫狂惊悸，或喘咳痰稠、大便秘结。二陈丸（C错）【主治】痰湿停滞导致的咳嗽痰多、胸脘胀闷、恶心呕吐。橘贝半夏颗粒（D错）【主治】痰气阻肺，咳嗽痰多、胸闷气急。复方鲜竹沥液（E错）【主治】痰热咳嗽，痰黄黏稠。